下列各项，除哪项外，均为各种淋证的共同表现
A. 小便频急
B. 腰部酸痛
C. 淋沥涩痛
D. 尿血而痛
E. 小腹拘急

正确答案：D。尿血而痛

解析：淋证病在膀胱和肾，且与肝脾有关，其病机主要是湿热蕴结下焦，导致膀胱气化不利，以小便频涩，淋沥涩痛，小腹拘急引痛为主症（ACE对），小腹拘急引痛多痛引腰腹，腰部酸痛（B对）。尿血而痛为血淋的典型表现（D错，为本题正确答案）。